5个月男婴，体重6kg，每天所需热卡为
A. 初为3MJ/d，以后根据食欲及消化道情况渐增到0.63MJ/（kg·d），待体重接近正常后恢复到生理需要量
B. 初为1.36MJ/d，以后根据食欲及消化道情况渐增到0.5～0.63MJ/（kg·d），待体重接近正常后恢复到生理需要量
C. 2.76MJ/d
D. 初为0.6MJ/d，以后根据食欲及消化道情况渐增到0.63MJ/（kg·d），待体重接近正常后恢复到生理需要量
E. 初为1.25MJ/d，1周后根据食欲及消化道情况渐增到0.63MJ/（kg·d），待体重接近正常后恢复到生理需要量

正确答案：C。2.76MJ/d

解析：本题考查儿童合理营养与膳食的相关概念。该5个月男婴，体重为6kg，较于5个月男婴的体重标准5.3kg～9.2kg左右，平均7.2kg相对偏低，属于在正常范围之内，因此该男婴每天所需热卡为2.76MJ/d（C对ABDE错）。